阻塞性肺不张时不会出现的体征是
A. 病变部位呼吸音减弱
B. 病变部位叩诊呈浊音
C. 病变部位触觉震颤增强
D. 气管向患侧移位
E. 胸廓可有塌陷

正确答案：C。病变部位触觉震颤增强

解析：阻塞性肺不张系指因气道阻塞而导致一个或多个肺段或肺叶的容量或含气量减少。呼吸音来自于气流通过呼吸道和肺泡，产生湍流引起振动，发出声响。阻塞性肺不张时，气流受限，呼吸音减弱（A对）；语颤传导不良，语颤减弱（C错，为本题正确答案）；肺含气量减少，叩诊由清音变浊（B对）；因肺不张，胸廓可有塌陷（E对），气管向患侧移位（D对）。